均具有祛风湿利水功效的药物是
A. 豨莶草
B. 防己
C. 威灵仙
D. 桑寄生
E. 蕲蛇

正确答案：B。防己

解析：防己性味苦寒，归膀胱、肺经，本品辛能行散，苦寒降泄，既能祛风湿止痛，又能清热利水（B对）。豨莶草的功效为祛风湿，利关节，解毒（A错）。威灵仙的功效为祛风湿，通经络，止痛，消骨骾（C错）。桑寄生的功效为祛风湿，补肝肾，强筋骨，安胎元（D错）。蕲蛇的功效为祛风，通络，止痉（E错）。